气候成为某些流行病的重要流行因素，以致传染病有明显的季节性，例如：呼吸道感染、支原体肺炎等病
A. 秋冬季多见
B. 冬春季多见
C. 春夏季多见
D. 夏冬季多见
E. 夏秋季多见

正确答案：B。冬春季多见

解析：本题考查气候对疾病流行的影响。气候条件会直接影响许多生物性病原体（病毒、细菌、寄生虫等）和生物性传媒（如蚊、蝇、虱、钉螺等生物）的生长繁殖和疾病的传染或传播力，从而间接地决定了某些传染病的高发或蔓延。例如：呼吸道感染、支原体肺炎等病冬春季多见（B对ACDE错）。